证候的概念是
A. 疾病发展某一阶段的病理概括
B. 是对疾病症状与体征的鉴别概括
C. 是对疾病症状与体征的分析概括
D. 对疾病表现症状的综合概括
E. 对阴阳气血失调临床表现的概括

正确答案：A。疾病发展某一阶段的病理概括

解析：证是疾病过程中某一阶段或某一类型的病理概括，一般由一组相对固定的、有内在联系的、能揭示疾病某一阶段或某一类型病变本质的症状和体征构成（A对）。